等渗性脱水
A. 细胞外液容量增加
B. 细胞内液容量增加
C. 两者均有
D. 两者均无
E. 无

正确答案：D。两者均无

解析：等渗性脱水时细胞外液水钠成比例丢失，细胞外液容量减少（A错），但细胞外液渗透压仍在正常范围，细胞内外无液体交换，细胞内液容量不变（B错，故D为本题正确答案）。